男性，35岁。右肾疼痛，尿常规红细胞充满视野，白细胞2-3个/HP，尿路平片可见右下段输尿管走行区高密度阴影0.6cm，IVU可见右输尿管下段结石，其上输尿管轻度扩张，右肾轻度积水。输尿管结石绞痛发作时应给予的治疗
A. 大量饮水促使结石排出
B. 体外震波碎石
C. 立即手术取石
D. 输尿管导管套石
E. 用药物解除绞痛症状

正确答案：E。用药物解除绞痛症状

解析：根据患者尿路平片和IVU所示，该患者可诊断为右下段输尿管结石，结石直径0.6cm，可采用药物排石治疗。当发生绞痛时，需紧急处理，应立即使用药物解除绞痛症状（E对）。大量饮水促使结石排出（A错）、体外震波碎石（B错）、立即手术取石（C错）、输尿管导管套石（D错）虽都可用于输尿管结石的治疗，但均不是当前首要的治疗措施。大量饮水主要适用于直径＜0.6cm、表面光滑结石的治疗。体外震波碎石主要适用于直径≤2cm肾结石及输尿管上段结石。手术取石可用于肾盏结石、肾盂输尿管处梗阻并肾盂结石，由于创伤较大，现多已不使用。输尿管导管套石主要适用于输尿管中下段的直径＜2cm的结石治疗。